婴幼儿应保持适当的
A. 正氮平衡
B. 零氮平衡
C. 零氨平衡并富裕5%
D. 零氮平衡并减少5%
E. 负氮平衡

正确答案：A。正氮平衡